主要作用是凝集致龋菌，减少菌斑形成，解脱已黏附菌斑，防止口腔pH下降的物质是
A. 红花
B. 茶多酚
C. 甲壳素类
D. 氯已定
E. 酶类

正确答案：C。甲壳素类

解析：本题考查抗菌斑附着剂。主要作用是凝集致龋菌，减少菌斑形成，解脱已黏附菌斑，防止口腔pH下降的物质是甲壳素类（C对）。甲壳素类属氨基多糖类物质，有多种衍生物，无毒副作用，在防龋研究上，主要作用是凝集致龋菌，减少菌斑形成，解脱已黏附菌斑，同时能减少乳酸量，防止口腔pH下降。红花（A错）作为天然植物药，可与获得性膜粘蛋白中富脯酸结合，阻止细菌粘附，与口腔pH无关。茶多酚（B错）除了有较弱的抑菌作用外，主要的作用是抑制葡糖基转移酶活性，减少葡聚糖的合成，不能防止口腔pH下降。氯己定（D错）作用表现在可减少唾液中吸附到牙面上的细菌数量；使唾液糖蛋白对牙面的吸附作用减弱；可与牙面釉质结合从而阻碍唾液细菌对牙面的吸附；可与Ca2+竞争，而取代Ca2+与唾液中凝集细菌的酸性凝集银子作用并使之沉淀，从而改变菌斑细菌的内聚力，抑制细菌的聚积和对牙面的吸附，与口腔pH值无关。酶类（E错）的作用主要是破坏细菌表面蛋白，阻止致龋菌在牙体的附着，没有防止口腔PH降低的作用。